某慢性肾功能衰竭患者，因反复呕吐急诊入院，血气分析结果为：pH7.40,PaCO₂（5.90kPa）44mmHg,HCO₃⁻26mmol/LNa⁺142mmol/L,CL⁻96mmol/L,应诊断为
A. AG增高性代谢性酸中毒
B. AG增高性代谢性酸中毒合并代谢性碱中毒
C. AG正常性代谢性酸中毒
D. AG正常性代谢性酸中毒合并代谢性碱中毒
E. 完全代偿性呼吸性酸中毒

正确答案：B。AG增高性代谢性酸中毒合并代谢性碱中毒

解析：AG= Na+- (HC03-+Cl-）=20 mmoI/L>16 mmoI/L，提示患者存在AG增高性代谢性酸中毒，由于pH7.40在正常范围内，说明患者同时存在程度相近的混合型酸、碱中毒，同时根据患者反复呕吐的病史可判断存在代谢性碱中毒，故诊断为AG增高性代谢性酸中毒合并代谢性碱中毒（B对）。